男，67岁。慢性咳喘20年，间断性下肢水肿3年。查体：BP120/80mmHg，颈静脉怒张，左下肺可闻及干湿啰音，心界向左扩大，P₂＞A₂，三尖瓣区可闻及3/6级杂音。肝肋下3cm。与上述诊断符合的心脏改变是
A. 心包积液
B. 室间隔肥厚
C. 冠状动脉狭窄
D. 右心室扩大
E. 心脏瓣膜粘连

正确答案：D。右心室扩大

解析：患者为老年男性，慢性咳嗽20年，间断性下肢水肿3年，现出现颈静脉怒张，心界向左扩大，P₂＞A₂（提示肺动脉高压），三尖瓣区可闻及3/6级杂音，肝肋下3cm（提示右心衰竭），考虑诊断为肺源性心脏病。COPD导致患者肺动脉高压形成，右心发挥其代偿功能，以克服升高的肺动脉阻力而发生右心室扩大（D对）。心包积液（A错）（P304）常见低血压，心音低弱和颈静脉怒张，呼吸困难也是常见症状，但本患者血压正常，未出现心音低弱，故不符合患者心脏改变。室间隔肥厚（B错）常见于肥厚型心肌病（P266），肥厚型心肌病常见劳力性呼吸困难和乏力，可在3、4肋间闻及收缩期杂音，但较少出现干湿性啰音及P₂＞A₂的体征，与患者体征不符，所以不是患者心脏改变。冠状动脉狭窄（C错）常见于冠心病（P219）典型症状为阵发性胸前区疼痛或憋闷，休息或服用硝酸甘油后疼痛消失，与本患者症状不符，因此也不符合患者心脏改变。心脏瓣膜粘连（E错）常见于二尖瓣和主动脉瓣，常可在二尖瓣和主动脉瓣区闻及杂音，患者无这类杂音，所以也不符合患者心脏改变。